生产工艺过程中的物理性有害因素，不包括
A. 生产性粉尘
B. 非电离辐射
C. 电离辐射
D. 高温
E. 高气压

正确答案：A。生产性粉尘

解析：本题考查生产工艺过程中的物理性有害因素。生产工艺过程中的物理性有害因素包括异常气象条件（如高温（D对）、高湿、低温、高气压（E对）、低气压）；噪声、振动、非电离辐射（B对）（如可见光、紫外线、红外线、射频辐射、激光等）；电离辐射（C对）（如X射线、γ射线等）。生产性粉尘（A错，为本题正确答案）属于化学性有害因素。